一种药物的功效能够被另一种药物减弱或消除，其配伍关系是
A. 相使
B. 相畏
C. 相杀
D. 相恶
E. 相反

正确答案：D。相恶

解析：相恶即两药合用，一种中药能使另一种中药原有功效降低，甚至丧失（D对）。相使是在性能功效方面有某些共性，或性能功效虽不相同，但是治疗目的一致的中药配合应用，其中以一种中药为主，另一种中药为辅，两药合用，辅药可以提高主药的功效（A错）。相畏是一种中药的毒性或副作用能被另一种中药降低或消除（B错）。相杀是一种中药能够降低或消除另一种中药的毒性或副作用（C错）。相反是两种中药同用能产生或增强毒性或副作用（E错）。